稳重但不灵活：忍耐力强、沉着但缺乏生气是哪种人的气质特征
A. 胆汁质
B. 多血质
C. 黏液质
D. 抑郁质
E. 其他

正确答案：C。黏液质